下列疾病，常使气管移向患侧的是
A. 胸膜粘连
B. 大量胸腔积液
C. 胸腔积气
D. 肺气肿
E. 纵隔肿瘤

正确答案：A。胸膜粘连

解析：使气管移向患侧的疾病有肺不张、肺硬化、胸膜粘连（A对）。大量胸腔积液（B错）、胸腔积气（C错）、肺气肿（D错）、纵隔肿瘤（E错）使气管向健侧移位。